豆蔻性状鉴别特征有
A. 类球形
B. 表面棕褐色
C. 种子不规则多面体
D. 气芳香
E. 味辛凉略似樟脑

正确答案：A、C、D、E。类球形；种子不规则多面体；气芳香；味辛凉略似樟脑

解析：本题考查的是药材豆蔻的性状特征。豆蔻性状鉴别特征有类球形（A对）、种子不规则多面体（C对）、气芳香（D对）与味辛凉略似樟脑（E对）。豆蔻：【性状鉴别】药材原豆蔻呈类球形。表面黄白色至淡黄棕色（B错），有3条较深的纵向槽纹，顶端有突起的柱基，基部有凹下的果柄痕，两端均具浅棕色绒毛。果皮体轻，质脆，易纵向裂开，内分3室，每室含种子约10粒；种子呈不规则多面体，背面略隆起，表面暗棕色，有皱纹，并被有残留的假种皮。气芳香，味辛凉，略似樟脑。